与前置胎盘的发生无关的是
A. 妊娠高血压综合征
B. 双胎妊娠
C. 多次刮宫
D. 胎盘面积过大
E. 受精卵滋养层发育迟缓

正确答案：A。妊娠高血压综合征

解析：胎盘大小和形态异常，均可发生前置胎盘。胎盘面积过大（D对）而延伸至子宫下段，前置胎盘发生率双胎（B对）较单胎高1倍。多次流产及刮宫（C对）为子宫内膜损伤引发前置胎盘的常见因素。受精卵滋养层发育迟缓（E对），当受精卵到达子宫腔后，滋养层尚未发育到可以着床的阶段，继续向下移动，着床于子宫下段而发育成前置胎盘。妊娠高血压综合征（P64）（A错，为本题正确答案）是妊娠与血压升高并存的一组疾病，（P129）是胎盘早剥发生的高危因素，与前置胎盘的发生无关。